肾功能不全病人，可使用正常剂量或略减的药物是
A. 庆大霉素
B. 氨苄西林
C. 多黏菌素
D. 万古霉素
E. 卡那霉素

正确答案：B。氨苄西林

解析：本题考查氨苄西林。氨苄西林（B对）肾毒性最小，对肾功能不全病人，可使用正常剂量或略减。庆大霉素（A错）、卡那霉素（E错）是氨基苷类抗生素，肾毒性较大，肾功能不全者宜减量使用。万古霉素（C错）和多黏菌素（D错）是多肽类化合物，对肾功能有一定的损害。